可杀灭疥虫的药物是
A. 林旦
B. 甲苯咪唑
C. 维A酸
D. 阿苯达唑
E. 咪康唑

正确答案：A。林旦

解析：本题考查杀灭疥虫的药物。可杀灭疥虫的药物是林旦（A对）。林旦是杀灭挤虫的有效药物，亦有杀灭乱和乱卵的作用，其与挤虫和乱体体表接触后，透过体壁，引起神经系统麻痹而死。甲苯咪唑（B错）和阿苯达唑（D错）为抗肠道蠕虫药。维A酸（C错）为治疗痤疮的药物。咪康唑（E错）为抗真菌药。